患者带下量多，色黄，质粘腻，有臭气，胸闷口腻，舌苔黄腻，脉濡数。其治法是
A. 健脾益气，升阳除湿
B. 温肾培元，固涩止带
C. 益肾滋阴，清热止带
D. 清利湿热止带
E. 清热解毒止带

正确答案：D。清利湿热止带

解析：患者带下量多，色黄，质黏腻，有臭气是因为湿热蕴结于下，损伤任带二脉；湿热内盛，阻于中焦，故有胸闷口腻，舌苔黄腻，脉濡数。属湿热下注证，治疗时要清利湿热（D对）。带下量多脾虚证治法为健脾益气，升阳除湿止带（A错）。带下量多肾阳虚证治法温肾培元，固涩止带（B错）。带下量多阴虚夹湿证治法滋肾益阴，清热利湿止带（C错）。带下量多热毒炽盛证治法清热解毒止带（E错）。